医师注册后应当由卫生行政部门注销注册的情形之一是
A. 受罚款行政处罚
B. 受警告行政处罚
C. 受责令暂停六个月执业活动的行政处罚
D. 中止医师执业活动满一年的
E. 受吊销执业证书行政处罚的

正确答案：E。受吊销执业证书行政处罚的

解析：医师注册后应当由卫生行政部门注销注册的情形之一是受吊销执业证书行政处罚的（E对C错）。中止医师执业活动满一年的（D错）不符合，应该是满两年。受罚款行政处罚（A错）；受警告行政处罚（B错）。